眶上神经通过
A. 眶上裂
B. 眶上孔(切迹)
C. 眶下裂
D. 眶下孔
E. 颏孔

正确答案：B。眶上孔(切迹)

解析：眶上神经为眼神经分支中额神经的分支，从眶上切迹（B对）穿出，分布于额顶、上睑部皮肤。眶上裂（A错）有眼神经通过。眶下裂（C错）有上颌神经通过。眶下孔（D错）有眶下神经（上颌神经分支）通过。